下列哪个选项属于消化道有益菌
A. 大肠埃希菌
B. 双歧杆菌
C. 肠炎杆菌
D. 变形杆菌
E. 肉毒梭菌

正确答案：B。双歧杆菌

解析：双歧杆菌（B对）在人体肠内发酵后可产生乳酸和醋酸，能提高钙、磷、铁的利用率，具有治疗慢性腹泻、治疗便秘、保护肝脏、防治心血管疾病、改善乳糖消化等的作用，属于肠道益生菌。大肠埃希菌（A错）在肠道中能为宿主提供一些具有营养作用的合成代谢产物，但在宿主免疫力下降或细菌侵入肠道外组织器官后，即可成为机会致病菌，可引起肠道外感染，有一些血清型的大肠埃希菌有致病性，能导致人类肠胃炎（P109）。变型杆菌（D错）为肠道正常菌群，在宿主免疫力下降或细菌侵入肠道外组织器官后，即可成为机会致病菌，多为继发感染，如慢性中耳炎、创伤感染等，也可引起膀胱炎、婴儿腹泻、食物中毒等（P122）。肉毒梭菌（E错）主要存在于土壤中，产生的肉毒毒素是已知最剧烈的毒物，导致的疾病最常见的是肉毒中毒和婴儿肉毒病（P136）。肠炎杆菌（C错）的说法不准确。